应激时体内分泌增加最多的激素是
A. 儿茶酚胺
B. 胰高血糖素
C. ACTH
D. 糖皮质激素
E. 胰岛素

正确答案：A。儿茶酚胺

解析：儿茶酚胺（A对）是应激时体内分泌增加最多的激素。